所谓的“四苗防六病”中的四苗是
A. 卡介苗、乙肝疫苗、麻疹疫苗、流脑疫苗
B. 流感疫苗、百白破疫苗、麻疹疫苗、卡介苗
C. 卡介苗、脊髓灰质炎疫苗、百白破疫苗、乙肝疫苗
D. 卡介苗、脊髓灰质炎疫苗、百白破疫苗、麻疹疫苗

正确答案：D。卡介苗、脊髓灰质炎疫苗、百白破疫苗、麻疹疫苗

解析：本题考查“四苗防六病”中的四苗。所谓的“四苗防六病”中的四苗是卡介苗、脊髓灰质炎疫苗、百白破疫苗、麻疹疫苗（D对ABC错），六病是结核病、脊髓灰质炎、百日咳、白喉、破伤风和麻疹。